功专止咳祛痰的药是
A. 川贝止咳露
B. 百合固金丸
C. 蛇胆川贝液
D. 雪梨膏
E. 芒果止咳片

正确答案：A。川贝止咳露

解析：本题考查的是川贝止咳露的功能。功专止咳祛痰的药是川贝止咳露（A对）。川贝止咳露：【功能】止嗽祛痰。蛇胆川贝液（C错）：【药物组成】蛇胆汁、川贝母。【功能】清肺，止咳，祛痰。【主治】肺热咳嗽，痰多。百合固金丸（B错）、雪梨膏（D错）与芒果止咳片（E错）的功能，2022年考试指南未明确说明。